在我国最多见的淋巴癌类型是
A. MALT淋巴癌
B. 弥浸性大B细胞淋巴瘤
C. NK/T细胞淋巴癌
D. 蕈样霉菌病
E. 滤泡性淋巴瘤

正确答案：B。弥浸性大B细胞淋巴瘤

解析：非霍奇金淋巴瘤（NHL）约占所有淋巴癌的80%～90%，主要分为前体淋巴细胞肿瘤、成熟B细胞淋巴瘤、成熟T细胞和NK细胞淋巴瘤。在我国，弥浸性大B细胞淋巴瘤（B对）约占所有NHL的30%～40%，是最多见的NHL类型。MALT淋巴瘤（结外边缘区黏膜相关淋巴组织淋巴瘤）（A错）仅占所有B细胞淋巴瘤的7%～8%（P229）。NK/T细胞淋巴瘤（C错）约占所有NHL的5%～20%（P232）。蕈样霉菌病（D错）是一种成熟T细胞淋巴瘤，较为少见。滤泡性淋巴瘤（E错）约占NHL的5%～10%（P227）。